女，25岁。肛门疼痛2天，无便血。检查：体温36.7°℃，肛门口有直径1cm暗紫色肿物，表面光滑，边界清楚，质硬，触痛明显。最可能的诊断是
A. 血栓性外痔
B. 肛门黑素瘤
C. 内痔脱出坏死
D. 直肠息肉脱出
E. 肛裂所致前哨痔

正确答案：A。血栓性外痔

解析：青年女性患者，肛门疼痛，无便血，查体：体温36.7℃，肛门口有直径1cm暗紫色肿物，表面光滑，边界清楚，质硬，触痛明显（血栓性外痔的特征性表现），根据该患者的临床症状及体征，考虑最可能的诊断为血栓性外痔（A对）。肛门黑素瘤（B错）多发生于50-60岁成年人，病变大体主要呈息肉状，有蒂或呈无蒂状，常可见黑色素沉积，肿物周围有时可见卫星结节。内痔（C错）常见的症状是间歇性便后出鲜血及脱出，该患者无便血。低位直肠息肉带蒂脱出（D错）肛门外易误诊为痔脱出，但息肉为圆形、实质性、有蒂、可活动，这种情况多见于儿童。肛裂所致前哨痔（E错）是直肠下端皮肤因炎症、水肿及静脉、淋巴回流受阻，形成袋状皮垂向下突出于肛门外，且肛裂病人临床表现是疼痛、便秘和出血。